对糖皮质激素结构与活性关系描述错误的是
A. 对21位羟基的酯化修饰，可改变药物的理化性质或稳定性
B. 在1位脱氢，可使抗炎作用增大，而钠潴留作用不变
C. 在9α位引入氟，抗炎作用增大，但盐代谢作用不变
D. 在6位引入氟，抗炎作用增大，钠潴留作用增加
E. 在16位、17位的羟基与丙酮缩合为缩酮，增加疗效

正确答案：C。在9α位引入氟，抗炎作用增大，但盐代谢作用不变

解析：本题考查肾上腺糖皮质激素药。在糖皮质激素9α-位引入氟原子后，增加了邻近11β-羟基的离子化程度，其抗炎活性和钠潴留副作用会同时增加（C错，为本题正确答案）。对21位羟基的酯化修饰，可改变药物的理化性质或稳定性（A对）。在1位脱氢增加双键，A环形状改变，使其抗炎活性增大，而钠潴留作用不变（B对）。在6位引入氟，增加脂溶性减缓代谢，抗炎活性增大，钠潴留副作用增加（D对）。在16位、17位的羟基与丙酮缩合为缩酮，脂溶性增大，增加疗效（E对）。